患者，女，41岁。精神抑郁善忧，情绪不宁，伴胸胁胀满，脘闷嗳气，不思饮食，大便不调，脉弦。治疗除取主穴外，还应选用的穴位是
A. 曲泉、膻中、期门
B. 行间、侠溪、外关
C. 通里、心俞、三阴交、太溪
D. 太溪、三阴交、肝俞、肾俞
E. 心俞、脾俞、足三里、三阴交

正确答案：A。曲泉、膻中、期门

解析：该患者为女性，以精神抑郁善忧，情绪不宁为主症，故诊断为郁证。胸胁胀满，脘闷嗳气，不思饮食，大便不调，脉弦为肝气郁滞之象，故辨为肝气郁结证。郁证肝气郁结证除选主穴外，还应配膻中、期门，曲泉为肝经合穴，能疏肝解郁（A对）。行间、侠溪、外关为郁证气郁化火证的配穴（B错）。通里、心俞、三阴交、太溪为郁证心神惑乱者的配穴（C错）。太溪、三阴交、肝俞、肾俞为郁证肝肾亏虚证的配穴（D错）。心俞、脾俞、足三里、三阴交为郁证心脾两虚证的配穴（E错）。